患者，男，60岁。慢性支气管炎病史20年，肺心病病史5年。近1周感冒后咳嗽，吐黄痰，心悸气短加重。下列哪项治疗原则是最重要的
A. 止咳
B. 祛痰
C. 抗感染
D. 强心
E. 利尿

正确答案：C。抗感染

解析：患者为中老年男性，慢性支气管炎病史20年，肺心病病史5年。近1周感冒后咳嗽，吐黄痰，心悸气短加重，考虑诊断为肺源性心脏病。由于呼吸系统感染是导致慢性肺心病加重致肺、心功能失代偿的常见原因，故治疗最重要的是控制感染（C对）。止咳（A错）、祛痰（B错）、强心（D错）、利尿（E错）虽为肺心病治疗原则，但不是最重要的原则。